在五行中，“土”的特性为
A. 升腾
B. 收敛
C. 滋润
D. 生化
E. 升发

正确答案：D。生化

解析：本题考查的是五行的特性。在五行中，“土”的特性为生化（D对）。五行的特性：1.木的特性：“木曰曲直”。“曲直”是指树木的生长形态，为枝干曲直，向上向外周舒展。因而引申为具有生长、升发（E错）、条达舒畅等作用的事物，均归属于木。2.火的特性：“火曰炎上”。“炎上”是指火具有温热、上升的特性。因而引申为具有温热、升腾（A错）等作用的事物，均归属于火。3.土的特性：“土爰稼穑”。“稼穑”是指土有播种和收获农作物的作用。因而引申为具有生化、承载、受纳等作用的事物，均归属于土。故有“土为万物之母”之说。4.金的特性：“金曰从革”。“从革”是指“变革”的特性。引申为具有清洁、肃降、收敛（B错）等作用的事物，均归属于金。5.水的特性：“水曰润下”。“润下”是指水具有滋润和向下的特性。引申为具有寒凉、滋润（C错）、向下运行等作用的事物，均归属于水。